大肠经在上肢的循行部位是
A. 外侧前缘
B. 内侧中线
C. 外侧后缘
D. 内侧前缘
E. 外侧中线

正确答案：A。外侧前缘

解析：手三阳经位于上肢外侧，具体为阳明在前、少阳在中（侧）、太阳在后，故手阳明大肠经循行于上肢外侧前缘（A对）。循行于上肢外侧后缘的是手太阳小肠经（C错）。循行于上肢外侧中线的是手少阳三焦经（E错）。手三阴经分布于上肢内侧，其中循行于上肢内侧前缘的为手太阴肺经（D错）、上肢内侧中线的为手厥阴心包经（B错）、上肢内侧后缘的为手少阴心经。